患者头微痛，恶寒无汗，咳嗽痰稀，鼻塞咽干，舌苔白，脉弦。治疗应首选
A. 桑杏汤
B. 杏苏散
C. 麻黄汤
D. 止嗽散
E. 川芎茶调散

正确答案：B。杏苏散

解析：患者头微痛，恶寒无汗，提示机体感受寒邪；根据鼻塞咽干，可知体内津液耗伤；咳嗽痰稀，舌苔白，可知肺气宣降失职。此皆为感受凉燥的症状，故用杏苏散轻宣凉燥，理肺化痰（B对）。桑杏汤（A错）的功用为清宣温燥，润肺止咳。主治：外感温燥证。麻黄汤（C错）的功用为发汗解表，宣肺平喘。主治：外感风寒表实证。止嗽散（D错）的功用为宣利肺气，疏风止咳。主治：风邪犯肺之咳嗽证。川芎茶调散（E错）的功用为疏风止痛。主治：风邪外袭，上扰头目之头痛。